关于出血坏死型急性胰腺炎的诊断，下列哪项错误
A. 血钙显著升高
B. 无糖尿病史而血糖升高
C. 血清淀粉酶突然下降
D. 烦躁不安，四肢厥冷，有休克表现
E. 范围广泛的剧烈腹痛伴高热与腹膜刺激征象

正确答案：A。血钙显著升高

解析：对于出血坏死型急性胰腺炎，因钙离子流入腺泡细胞，胰腺坏死，所以血钙＜2mmol/L，并非显著升高（A错，为本题正确答案）。因胰岛素释放减少、胰高血糖素释放增加、胰腺坏死会出现血糖升高（B对）。淀粉酶在起病后6～12小时开始升高，48小时开始下降，出血坏死型胰腺炎淀粉酶值可正常或低于正常（C对）。急性胰腺炎是急腹症之一，并且有严重感染和炎症反应，因此有烦躁不安，四肢厥冷，休克，范围广泛的剧烈腹痛伴高热与腹膜刺激征象（DE对）。